拔牙时晕厥的处理下列哪项是不必要的
A. 立即停止手术保持呼吸道畅通
B. 嗅闻刺激性气体
C. 吸氧
D. 输液纠正酸碱平衡紊乱
E. 必要时静脉推注高渗葡萄糖

正确答案：D。输液纠正酸碱平衡紊乱

解析：本题考查晕厥的防治措施。拔牙时晕厥的处理不必要的是输液纠正酸碱平衡紊乱（D错，为本题的正确答案）。晕厥是一时的中枢性缺血所致的突发性、暂时性意识丧失，多由恐惧、疲劳、饥饿或身体状况差所致，与酸碱平衡紊乱无关，故无需输液纠正酸碱平衡。发生晕厥时要立即停止手术保持呼吸道畅通（A对），必要时可吸氧（C对）；嗅闻刺激性气体（芳香氨乙醇或氨水）可以刺激患者呼吸（B对）；必要时静脉推注高渗葡萄糖（E对），有助于患者恢复意识。